《执业医师法》明确规定，医师在执业过程中应当履行的职责是
A. 以病人为中心，实行人道主义精神
B. 防病治病，救死扶伤
C. 遵守职业道德，保护患者隐私
D. 树立敬业精神，尽职尽责为患者服务
E. 防病治病，救死扶伤，保护人民健康

正确答案：E。防病治病，救死扶伤，保护人民健康

解析：根据《执业医师法》规定，医师在执业过程中应当履行防病治病、救死扶伤、保护人民健康（E对）的职责。《执业医师法》规定，医师在执业活动中遵守职业道德，保护患者隐私（C错）、树立敬业精神，尽职尽责为患者服务（D错）属于医师在执业活动中履行的义务（P248），不属于应当履行的职责。